用基准邻苯二甲酸氢钾标定氢氧化钠滴定液时，已知邻苯二甲酸氢钾的分子量为204.22，则1ml氢氧化钠滴定液（0.1mol/l，）相当于邻苯二甲酸氢钾的量是
A. 1.021mg
B. 2.042mg
C. 10.21mg
D. 20.42mg
E. 204.2mg

正确答案：D。20.42mg